根据《麻醉药品和精神药品管理条例》，药品零售连锁企业门店从事第二类精神药品零售业务的审批部门是
A. 所在地省、自治区、直辖市卫生行政部门
B. 所在地省、自治区、直辖市药品监督管理部门
C. 所在地设区的市级卫生行政部门
D. 所在地设区的市级药品监督管理部门

正确答案：D。所在地设区的市级药品监督管理部门

解析：本题考查麻醉药品和精神药品定点经营资格审批。根据《麻醉药品和精神药品管理条例》，药品零售连锁企业门店从事第二类精神药品零售业务的审批部门是所在地设区的市级药品监督管理部门（D对）。麻醉药品和精神药品定点经营资格审批：1.跨省、自治区、直辖市从事麻醉药品和第一类精神药品批发业务的药品经营企业称为全国性批发企业，应当经国务院药品监督管理部门批准，并予以公布。国务院药品监督管理部门在批准全国性批发企业时，应当明确其所承担供药责任的区域。2.在本省、自治区、直辖市行政区域内从事麻醉药品和第一类精神药品批发业务的药品经营企业称为区域性批发企业，应当经所在地省级药品监督管理部门（B错）批准，并予以公布。省级药品监督管理部门在批准区域性批发企业时，应当明确其所承担供药责任的区域。3.专门从事第二类精神药品批发业务的药品经营企业，应当经所在地省级药品监督管理部门批准，并予以公布。仅取得第二类精神药品经营资格的药品批发企业，只能从事第二类精神药品批发业务。4.从事麻醉药品和第一类精神药品批发业务的全国性批发企业、区域性批发企业，可以从事第二类精神药品批发业务。如需开展此项业务，企业《药品经营许可证》的经营范围必须有此项目；如许可经营范围没有此项目的，企业应当向所在地省级药品监督管理部门申请变更《药品经营许可证》经营范围，企业所在地省级药品监督管理部门应当在其《药品经营许可证》经营范围中加注（第二类精神药品原料药或第二类精神药品制剂）。5.经所在地设区的市级药品监督管理部门批准，实行统一进货、统一配送、统一管理的药品零售连锁企业可以从事第二类精神药品零售业务。6.各级药品监督管理部门应当及时将批准的全国性批发企业、区域性批发企业、专门从事第二类精神药品批发的企业和从事第二类精神药品零售的连锁企业（含相应门店）的名单在网上公布。